石棉肺的主要并发症是
A. 肺感染
B. 肺结核
C. 肺气肿
D. 肺心病
E. 肺癌

正确答案：A。肺感染

解析：本题考查石棉肺的并发症。晚期石棉肺病人并发呼吸道及肺部感染（A对BCD错）较矽肺多见，但合并结核者比矽肺少。由于反复感染，往往可致心力衰竭。石棉肺病人并发肺心病的概率较矽肺病人多，且较为严重。肺癌和恶性间皮瘤是石棉肺的严重并发症。